促使缩胆囊素释放作用最强的物质是
A. 蛋白分解产物
B. 脂肪
C. 脂酸钠
D. 糖类
E. HCl

正确答案：A。蛋白分解产物